有关预防性卫生监督的概念中，错误的是
A. 对公共场所的建设进行监督
B. 对城乡规划进行监督
C. 对新建、改建、扩建的企业进行监督
D. 对住宅建设经常进行安全监督检查
E. 对建筑设计图纸进行卫生审查

正确答案：D。对住宅建设经常进行安全监督检查

解析：本题考查预防性卫生监督的概念。预防性卫生监督是指在卫生管理中，采取有效措施，防止卫生危害的发生，以保护公众健康的一种行为。预防性卫生监督的主要内容包括：对公共场所的建设进行监督（A对），对城乡规划进行监督（B对），对新建、改建、扩建的企业进行监督（C对），对建筑设计图纸进行卫生审查（E对）等。对住宅建设经常进行安全监督检查（D错，为本题正确答案）属于安全监督检查的范畴，而不属于预防性卫生监督的范畴。